下列各项，最易发生代谢性碱中毒的是
A. 慢性肾功能不全
B. 休克
C. 肠瘘
D. 幽门梗阻
E. 急性肾功能不全

正确答案：D。幽门梗阻

解析：最易发生代谢性碱中毒的是幽门梗阻（D对），幽门梗阻患者常表现为剧烈呕吐，大量丢失胃液，使体液中H+丢失过多。急性肾功能不全（E错）及慢性肾功能不全（A错）、休克（B错）、肠瘘（C错）表现为代谢性酸中毒。